Brown水质指数中筛选出的9项水质评价因子，不包括
A. 温度
B. 总硬度
C. 溶解氧
D. 硝酸盐
E. BOD₅

正确答案：B。总硬度